除外哪项均是人际传播的特点
A. 信息量大
B. 简便易行
C. 传播较慢
D. 针对性高
E. 互动性

正确答案：A。信息量大